说明商品的用途、性能、质量等信息应当真实全面，属于
A. 保证安全的义务
B. 出具凭证的义务
C. 提供信息的义务
D. 真实标记的义务

正确答案：C。提供信息的义务

解析：本题考查经营者的义务。经营者应当真实、全面向消费者提供有关商品或者服务的质量，性能、用途、有效期限等信息，承担提供信息的义务（C对）。提供信息的义务：经营者向消费者提供有关商品或者服务的质量、性能、用途、有效期限等信息，应当真实、全面，不得作虚假或者引人误解的宣传。保证安全的义务（A错）：经营者应当保证其提供的商品或者服务符合保障人身、财产安全的要求。对可能危及人身、财产安全的商品和服务，应当向消费者作出真实的说明和明确的警示，并说明和标明正确使用商品或者接受服务的方法以及防止危害发生的方法。出具凭证的义务（B错）：经营者提供商品或者服务，应当按照国家有关规定或者商业惯例向消费者出具发票等购货凭证或者服务单据。真实标记的义务（D错）：经营者应当标明其真实名称和标记。租赁他人柜台或者场地的经营者，应当标明其真实名称和标记。